疾病流行时，发病率高于当地散发发病水平的
A. 1～2倍
B. 2～5倍
C. 2～10倍
D. 3～10倍
E. 10倍以上

正确答案：D。3～10倍

解析：流行指某病在某地区的发病率显著超过历年（散发）的发病率水平。疾病流行时，各病例间有明显的时、空联系，发病率高于当地散发发病水平的3～10倍。掌握“流行病学资料与疾病分布”知识点。